经筛检后，对高血压水平的个体再检查，可预期复查者的血压值会下降属于
A. 历史性因素
B. 回归因素
C. 选择偏倚
D. 成熟因素
E. 测试因素

正确答案：B。回归因素